激惹性腹泻常见的病因是
A. 细菌、真菌、病毒、寄生虫感染
B. 变态反应或由肠肿瘤产生过多激素
C. 肠道正常细菌的数量或比例失去平衡
D. 外界的各种刺激，如受寒、过食辛辣食物等
E. 直肠或结肠溃疡、肿瘤或炎症

正确答案：D。外界的各种刺激，如受寒、过食辛辣食物等